二级召回应在___内，通知有关部门及单位
A. 一级召回
B. 二级召回
C. 三级召回
D. 48小时
E. 72小时

正确答案：D。48小时

解析：本题考查生产企业药品召回的时间规定。药品生产企业在作出药品召回决定后，应当制定召回计划并组织实施：一级召回在24小时内，二级召回在48小时内（D对），三级召回在72小时内（E错），通知到有关药品经营企业、使用单位停止销售和使用，同时向所在地省级药品监督管理部门报告。根据药品安全隐患的严重程度，药品召回分为三级：对使用该药品可能引起严重健康危害的实施一级召回（A错）；对使用该药品可能引起暂时的或者可逆的健康危害的实施二级召回（B错）；对使用该药品一般不会引起健康危害，但由于其他原因需要收回的实施三级召回（C错）。